常用于空气或物体表面的消毒
A. 高压蒸汽灭菌法
B. 紫外线消毒法
C. 巴氏消毒法
D. 滤过除菌法
E. 干烤法

正确答案：B。紫外线消毒法

解析：紫外线消毒的特点是穿透力差，且需照射30分钟～1小时才有效，仅适于直射物品表面消毒及对空气的消毒，尤其不能用于微生物的灭活处理，以免被激活后，微生物复活。掌握“消毒与灭菌”知识点。